广谱抗菌药，以左旋体为临床使用的是
A. 盐酸诺氟沙星
B. 磺胺嘧啶
C. 氧氟沙星
D. 司帕沙星
E. 甲氧苄啶

正确答案：C。氧氟沙星

解析：本题考查喹诺酮类抗菌药。氧氟沙星（C对）含有手性碳原子，左旋体抗菌活性大于右旋体，故以左旋体为临床使用。盐酸诺氟沙星（A错）、磺胺嘧啶（B错）、甲氧苄啶（E错）不具有光学异构体。司帕沙星（D错）不以左旋体为临床使用。